某男，45岁。平素喜饮浓茶，嗜好烟酒，经常熬夜。现入睡困难，且多梦易醒心悸健忘，虚烦不安，时有盗汗，舌淡，苔薄，脉细。医师诊断为不寐。对该患者的健康指导，正确的是
A. 晚餐不宜过饱，不饮浓茶，睡前推荐阅读，11点前入睡
B. 晚餐尽量饱食，不饮浓茶，睡前避免阅读，11点后入睡
C. 晚餐不宜过饱，不饮浓茶，睡前推荐阅读，11点后入睡
D. 晚餐不宜过饱，不饮浓茶，睡前避免阅读，11点前入睡
E. 晚餐尽量饱食，不饮浓茶，睡前避免阅读，11点前入睡

正确答案：D。晚餐不宜过饱，不饮浓茶，睡前避免阅读，11点前入睡

解析：本题考查的是不寐的健康指导。平素喜饮浓茶，嗜好烟酒，经常熬夜。现入睡困难，且多梦易醒心悸健忘，虚烦不安，时有盗汗，舌淡，苔薄，脉细。医师诊断为不寐。对该患者的健康指导，正确的是晚餐不宜过饱，不饮浓茶，睡前避免阅读，11点前入睡（D对）。不寐的健康指导：1.饮食宜忌：晚餐要清淡，不宜过饱（BE错）；更忌饮浓茶、喝咖啡及吸烟。平时可以选用玫瑰花、龙眼肉、酸枣仁、百合、莲子肉等药食两用的食物代茶饮或煮粥喝，以辅助调理睡眠。2.日常调护：积极进行心理情志调整，克服过度的紧张、兴奋、焦虑、抑郁、惊恐、愤怒等不良情绪，做到喜怒有节；保持精神舒畅，尽量以放松的顺其自然的心态对待睡眠，反而能较好地入睡。睡眠卫生方面，患者首先要建立有规律的作息制度，从事适当的体力活动或体育锻炼，增强体质，持之以恒，促进身心健康。其次养成良好的睡眠习惯。睡前避免从事紧张和兴奋的活动（AC错），养成定时就寝的习惯。另外，要注意睡眠环境的安宁，床铺要舒适，卧室光线要柔和，并努力减少噪音，去除各种可能影响睡眠的外在因素。